关于髋臼叙述不正确的是
A. 容纳股骨头大部分
B. 窝内的月状面为关节面
C. 由髂骨、坐骨和耻骨3骨体组成
D. 髋臼窝为髋关节窝
E. 股骨头韧带一端跗于髋臼横韧带上

正确答案：D。髋臼窝为髋关节窝

解析：髋臼由髂骨体、坐骨体、尺骨体组成（C对），较深，能够容纳股骨头大部分（A对）髋关节由多个韧带加强，其中股骨头韧带位于关节囊内，一端连于股骨头凹，另一端连于髋臼横韧带（E对）。髋臼中半月形月状面为关节面（B对），中央的凹陷部分称髋臼窝，此处应该明白髋臼窝仅为髋臼的一部分，二髋关节是以整个髋臼作为关节窝的，所以不能说髋臼窝为髋关节窝（D错，为本题正确答案）。